经产妇，28岁。合并风湿性心脏病，现妊娠38周，心功能Ⅰ级，规律宫缩7小时来院。枕左前位，胎心152次/分，估计胎儿3300g，宫口开大4cm，胎头=0，本例正确的处理措施是
A. 适当使用镇静剂，阴道助产
B. 避免用力屏气加腹压，胎头吸引或产钳助产
C. 静滴缩宫素，尽可能缩短第一产程
D. 试产期间若出现心衰症状，应立即行剖宫产
E. 不行阴道试产，行剖宫产术结束分娩

正确答案：A。适当使用镇静剂，阴道助产

解析：阴道分娩的指征为心功能Ⅰ～Ⅱ级、胎儿不大，胎位正常、宫颈条件良好者。该产妇规律宫缩7小时，宫口开大4cm（属第一产程），胎头=0，均属正常征象，心功能Ⅰ级，胎儿3300g（胎儿不大），枕左前位（胎位正常），因此可行阴道试产（E错），此时要安稳及鼓励孕妇，消除紧张情绪，可适当应用地西泮、哌替啶等镇静剂（A对）。第二产程要避免用力屏气加腹压，以免增加心脏负荷，同时行胎头吸引或产钳助产尽快结束分娩过程，防止产妇心衰症状加重（B错）。若试产期间出现心衰症状加重，发展为心功能Ⅲ～Ⅳ级，应立即行剖宫产（D错）。当出现协调性宫缩乏力或不协调宫缩乏力恢复协调性时，可以静脉滴注缩宫素，由于该产妇暂无产力异常，且静滴缩宫素（C错）是第三产程的处理措施。